对于“意外穿髓”，其原则上的补救方法为
A. 安抚治疗
B. 直接充填
C. 垫底充填
D. 不做治疗
E. 根据情况选择直接盖髓术或根管治疗

正确答案：E。根据情况选择直接盖髓术或根管治疗

解析：本题考查意外穿髓的处理。对于“意外穿髓”，其原则上的补救方法为根据情况选择直接盖髓术或根管治疗（E对）。意外穿髓的处理为根据患者的年龄、牙位、穿髓孔的大小选择直接盖髓术或进行根管治疗。